依照《药品说明书规范细则（暂行）》的规定对于解热镇痛药“泰诺林”而言，“对乙酰氨基酚”是它的
A. 通用名
B. 曾用名
C. 商品名
D. 化学名
E. 汉语拼音

正确答案：A。通用名

解析：本题考查通用名。依照《药品说明书规范细则（暂行）》的规定对于解热镇痛药“泰诺林”而言，“对乙酰氨基酚”是它的通用名（A对）。药品通用名也称为国际非专利药品名称（INN），通常是指有活性的药物物质，而不是最终的药品，因此是药学研究人员和医务人员使用的共同名称。药品的曾用名（B错）是指属原地方标准采用的名称。药品的商品名（C错）通常是针对药物的最终产品，即剂量和剂型已确定的含有一种或多种药物活性成分的药物。药物的化学名（D错）是根据药品的化学成分确定的化学学术名称。